再生障碍性贫血气血两虚证，治疗应首选
A. 杞菊地黄丸
B. 大补阴丸
C. 左归丸
D. 八珍汤
E. 右归丸

正确答案：D。八珍汤

解析：八珍汤功能益气养血，可用于治疗再生障碍性贫血气血两虚证（D对）。杞菊地黄丸功能滋肾养肝明目，用于治疗关格肝肾阴虚，肝风内动证（A错）。大补阴丸功能滋阴降火，可用治遗精君相火旺证（B错）。左归丸功能滋阴补肾，填精益髓，为眩晕肾精不足证选方（C错）。右归丸功能温补肾阳，填精益髓，为肾阳虚腰疼代表方（E错）。